（109～111题共用题干）男婴，4个月。反复发作性吸入性呼吸困难伴吸气时喉鸣，口唇青紫3次。无发热。发作期间一般情况良好。枕部指压有乒乓球样感，肺、心未见异常。该患儿再次突然出现发作性呼吸困难缺氧时，首要的急救措施是
A. 气管插管
B. 静注钙剂
C. 应用地西泮，保持呼吸道通畅
D. 应用甘露醇
E. 补充维生素D

正确答案：C。应用地西泮，保持呼吸道通畅

解析：患者男婴，4个月（维生素D缺乏性手足抽搐症的好发人群）。反复发作性吸入性呼吸困难伴吸气时喉鸣，口唇青紫3次（临床反复出现呼吸困难、缺氧表现，提示存在维生素D缺乏性手足抽搐可能）。无发热（排除高热惊厥可能）。发作期间一般情况良好。枕部指压有乒乓球样感（维生素D缺乏性佝偻病的典型体征），肺、心未见异常（排除呼吸循环系统病变导致的呼吸困难）。结合以上临床表现及体格检查，该患儿最有可能是维生素D缺乏性手足抽搐症。维生素D缺乏性手足抽搐征发生喉痉挛时情况危急，易发生窒息，所以此时的急救处理应为静注或肌注地西泮（C对）来控制喉痉挛，同时应给氧和保持呼吸道通畅，可进行口对口呼吸，必要时进行气管插管（A错）（P82）。静注钙剂（B错）和补充维生素D（E错）均为维生素D缺乏性手足抽搐征的治疗措施，但不用于急救（P82）。甘露醇（D错）（九版药理学P217）为脱水剂，常用于脱水利尿和降颅压。